公共卫生从业人员在职业性损害防控中应遵循的伦理要求除外
A. 依法开展卫生监督和管理，从源头控制职业性损害
B. 积极开展职业健康教育、卫生监测，保护劳动者身体健康
C. 深入农村、社区，将健康教育工作渗透到基本卫生保健工作中
D. 职业病诊断应客观公正
E. 既要保障劳动者的健康权益，又要维护企业和国家的利益

正确答案：C。深入农村、社区，将健康教育工作渗透到基本卫生保健工作中

解析：职业性损害应当引起国家和政府的重视，公共卫生从业人员应当在职业性损害防控中遵循以下伦理要求：①依法开展卫生监督和管理，从源头控制职业性损害，对劳动者的安全和健康负责；②积极开展职业健康教育、卫生监测和健康监护，保护劳动者身体健康；③职业病诊断应客观公正，既要保障劳动者的健康权益，也需维护企业和国家的利益。C项属于健康教育和健康促进工作中公共卫生从业人员应遵循的伦理要求。掌握“公共卫生工作伦理要求”知识点。